风湿性心脏病，休息时有心悸，呼吸困难或心绞痛，任何活动均可加重上述症状。判断为
A. KillipⅠ级
B. KillipⅡ级
C. KillipⅢ级
D. NYHAⅡ级
E. NYHAⅣ级

正确答案：E。NYHAⅣ级

解析：本例休息时即有心悸，呼吸困难或心绞痛，任何活动均可加重症状，符合NYHAⅣ级诊断（E对），NYHAⅡ级（D错）指患者体力活动轻度受限，休息时无自觉症状。根据有无心力衰竭表现及其相应的血流动力学改变严重程度，AMI（急性心肌梗死）引起的心力衰竭按Killip分级法（P236）可分为四级，其中KillipI级（A错）指尚无明显心力衰竭，KillipⅡ级（B错）指有心力衰竭，肺部啰音＜50%肺野，KillipⅢ级（C错）指有急性肺水肿，全肺大、小、干、湿啰音。本例患者并无急性心肌梗死，因此不能用Killip分级法。